黄斑之中央凹处，由哪些细胞组成
A. 色素上皮细胞、视锥细胞、节细胞
B. 色素上皮细胞、视锥细胞
C. 色素上皮细胞、视锥细胞、双极细胞
D. 色素上皮细胞、视杆细胞
E. 视锥细胞、视杆细胞

正确答案：B。色素上皮细胞、视锥细胞

解析：黄斑之中央凹处由密集的视锥细胞构成，无视杆细胞分布，且黄斑处的视网膜仅有一层色素上皮层，故黄斑之中央凹处由色素上皮细胞、视锥细胞（B对）组成。